具有几级以上专业技术职务任职资格的医师，经培训并考核合格后，方可授予限制使用级抗菌药物处方权
A. 初级
B. 中级
C. 高级
D. 初中高均可
E. 特高级

正确答案：B。中级

解析：《抗菌药物临床应用管理办法》规定，具有中级以上专业技术职务任职资格的医师，可授予限制级使用抗菌药物处方权。掌握“抗菌药物临床应用、监督及法律责任”知识点。